邪入营血证的舌象是
A. 舌色淡红
B. 舌质淡白
C. 舌质绛红
D. 舌质紫暗
E. 舌起粗大红刺

正确答案：C。舌质绛红

解析：舌为心之苗，心主血脉，温热病邪入营血，则见舌质绛红，舌有红刺（C对）。正常舌质淡红（A错）。若舌质淡白为气血虚亏（B错）。舌质紫黯或紫红，为气血瘀滞（D错）。舌起粗大红刺，状如草莓者，常见于猩红热（E错）。